下列关于药物过敏性口炎的临床特征中，正确的是
A. 皮肤出现红斑、肿胀，病损为单个或几个大小不等的水疱
B. 最常见的病损为结节性红斑
C. 有时在红斑的基础上出现水疱，称多形性红斑
D. 皮肤暗紫色丘疹，见白色条纹状
E. 无潜伏期，直接发病

正确答案：A。皮肤出现红斑、肿胀，病损为单个或几个大小不等的水疱

解析：本题考查药物过敏性口炎的临床特征。皮肤出现红斑、肿胀，病损为单个或几个大小不等的水疱（A对）为药物过敏性口炎的临床特征。药物过敏性口炎可发生于口腔任何部位，口腔病损可先于皮肤损害出现。单个水疱较大，舌背中部好发，水疱壁薄易破裂，口内不易看到完整水疱，疱破后可见残余疱壁，圆形或界限清楚的糜烂或溃疡，唇、舌、颊、腭等部位均可发生。无潜伏期，直接发病（E错），药物引起变态反应，需要一定的潜伏期。有时在红斑的基础上出现水疱，称多形性红斑（C错），圆形红斑中心有粟粒大小的水疱，为轻型多形红斑的典型病损，称虹膜状红斑，又称靶形红斑，多形红斑是一组急性炎症性疾病。皮肤暗紫色丘疹，见白色条纹状（D错）为口腔扁平苔藓的临床表现。最常见的病损为结节性红斑（B错）为白塞病的临床表现，多发生于下肢。